公共场所的下列项目符合国家卫生标准和要求，但不包括
A. 空气、微小气候
B. 水质、噪声
C. 采光、照明
D. 建筑的抗震性能
E. 顾客用具和卫生设施

正确答案：D。建筑的抗震性能